男性，30岁，突发左腰部绞痛伴镜下血尿，左腰部轻度压痛和叩击痛，无肌紧张，应考虑
A. 肾肿瘤
B. 肾结核
C. 急性肾盂肾炎
D. 肾输尿管结石
E. 肾积水

正确答案：D。肾输尿管结石

解析：青年男性患者，突发左腰部绞痛伴镜下血尿（提示可能有输尿管结石），左腰部轻度压痛和叩击痛（提示可能有肾结石），无肌紧张，结合患者病史、临床表现及相关检查，应考虑左侧肾输尿管结石（D对）。肾肿瘤（A错）常表现为间歇无痛肉眼血尿、腰痛和腹部肿块。肾结核（B错）典型表现为膀胱刺激症状伴终末血尿，可有低热、盗汗等结核中毒症状。急性肾盂肾炎（C错）主要表现为寒战、高热、腰痛和膀胱刺激症状。肾积水（E错）主要表现为腹部包块，不同原因引起的肾积水可有相应原发病的表现。